含有3，5-二羟基戊酸和吲哚环的第一个全合成他汀类调血脂药物
A. 辛伐他汀
B. 氟伐他汀
C. 普伐他汀
D. 西立伐他汀
E. 阿托伐他汀

正确答案：B。氟伐他汀

解析：本题考查他汀类药物的结构。氟伐他汀（B对）含有3，5-二羟基戊酸和吲哚环，是第一个全合成他汀类调血脂药物。辛伐他汀（A错）具有开环的二羟基戊酸侧链。普伐他汀钠（C错）是在洛伐他汀的基础上将内酯环开环成3，5-二羟基戊酸并与钠成盐，以及将十氢萘环2位的甲基用羟基取代而得的药物。阿托伐他汀钙（D错）用吡咯环替代洛伐他汀分子中的双环，具有开环的二羟基戊酸侧链。洛伐他汀（E错）属于前体药物，体外无HMG-CoA还原酶抑制作用。